有关流感地区分布特征的描述错误的是
A. 在世界各地均可以发生
B. 一般是城市后农村
C. 先平原后山区
D. 各地发病率水平相近
E. 流行往往沿交通线发展

正确答案：D。各地发病率水平相近

解析：本题考查流感的地区分布特征。流感在世界各地均可发生（A对），但各地之间的发病率可存在较大差异（D错，为本题正确答案）。这种地区分布的差异与病毒抗原的变异、人群密集程度、交往频度、传染源数量、人群免疫状况及防疫措施等有关。一般是先城市后农村（B对），先平原后山区（C对），沿交通线路发展（E对）。